一男性受到腹部闭合性损伤后出现腹部压痛、反跳痛、肌紧张，行腹部探查，术中依次探查肝、脾、膈均无损伤或出血，继续探查，应首先探查的脏器是
A. 胰腺
B. 胃
C. 直肠
D. 十二指肠
E. 空肠

正确答案：B。胃

解析：该男性受到腹部闭合性损伤，出现腹部压痛、反跳痛、肌紧张（考虑腹膜炎体征），如果没有腹腔内大出血，则应对腹腔脏器进行系统、有序的探查，做到既不遗漏伤情，又避免不必要的重复探查。术中已对肝、脾、膈探查均无出血，接着从胃（B对）开始，逐段探查十二指肠（D错）第一段、空肠（E错）、回肠、大肠（C错）以及其系膜，然后探查盆腔脏器，再后则切开胃结肠韧带显露网膜袋，检查胃后壁和胰腺（A错）；如有必要，最后还应切开后腹膜探查十二指肠二、三、四段。探查过程中发现的出血性损伤或脏器破裂，应随时进行止血或夹闭破口。